颅内肿瘤中最多见的是
A. 转移瘤
B. 脑膜瘤
C. 神经上皮性肿瘤
D. 垂体腺瘤
E. 胆脂瘤

正确答案：C。神经上皮性肿瘤

解析：颅内肿瘤中最多见的是神经上皮组织肿瘤（C对），占40%～50%。其次为脑膜瘤（B错），占颅内肿瘤的14.4%～19.0%，垂体腺瘤（D错）约占10%，听神经瘤占8%～10%。脑转移瘤（A错）的确切发生率尚难确定，统计资料认为约占颅内肿瘤的10%（七版黄家驷外科学P931）。胆脂瘤（E错）亦称表皮样囊肿，占颅内肿瘤的0.3%。